Kaplan-Meier法属于
A. 参数法
B. 非参数法
C. 半参数法
D. logistic回归
E. 以上均不是

正确答案：B。非参数法

解析：本题考查Kaplan-Meier法的性质。Kaplan-Meier法属于非参数法（B对ACDE错）。